关于质粒的叙述，下列哪项错误
A. 大小约为数千个碱基对
B. 是双链的线性分子
C. 存在于大多数细菌的胞质中
D. 易从一个细菌转移入另一个细菌
E. 常带抗药基因

正确答案：B。是双链的线性分子